诊断急性坏死性龈炎时除临床特征外，常用的辅助诊断方法
A. 活检
B. 细菌培养
C. 坏死物及牙龈组织培养
D. 病变区细菌学涂片
E. 脱落细胞检查

正确答案：D。病变区细菌学涂片

解析：本题考查急性坏死性龈炎的诊断。急性坏死性龈炎病变区的细菌学涂片检查（D对）有助于本病的诊断，可见大量病原菌，即梭形杆菌和螺旋体。活检（A错）易导致炎症扩散。大量临床细菌培养（B错）螺旋体均未成功。坏死物及牙龈组织培养（C错）可有混杂细菌影响诊断结果。脱落细胞检查（E错）用于检查细胞而非病原菌。